初孕妇，妊娠39周，剧烈持续腹痛4小时入院。贫血貌，血压130/80mmHg，脉搏120次/分，子宫硬，不松弛，有局限性压痛，胎位不清，胎心110次/分，阴道少量流血，肛查宫口未开。可能的诊断是
A. 前置胎盘
B. 先兆子痫
C. 继发性贫血
D. 低张性子宫收缩乏力
E. 胎盘早剥

正确答案：E。胎盘早剥

解析：该患者剧烈持续性腹痛，出现贫血貌，脉搏增快，子宫硬，宫缩间歇时不能松弛，胎位扪不清，宫口未开，故可能诊断是Ⅲ度胎盘早剥（E对）。前置胎盘（P127）（A错）的症状是无诱因、无痛性反复阴道流血，故排除之。先兆子痫（B错）出现收缩压≥140mmHg和（或）舒张压≥90mmHg，或伴有蛋白尿≥0.3g/24h，与该患者体征不符。继发性贫血（C错）、低张性子宫收缩乏力（D错）不会出现子宫硬，不松弛，有局限性压痛，胎位不清等症状。